女，23岁。停经两个月，大量阴道流血一天。心率100次/分。妇科检查见宫口有组织物排出，子宫如两个月妊娠大小。该患者的处理措施不包括
A. 肌注黄体酮
B. 给予输液及止血药物
C. 查血常规
D. 查血β-hCG
E. 立即行清宫术

正确答案：A。肌注黄体酮

解析：育龄女性患者，停经8周（早期流产发生在妊娠12周前），伴大量阴道流血，阴道妇科检查见宫口可见胚胎组织，子宫大小与停经周数基本相符，考虑难免流产，一旦确诊应尽早使胚胎及胎盘组织完全排出，早期流产应及时行清宫术（E对）。肌注黄体酮用于黄体功能不全引起的先兆流产患者（A错，为本题正确答案）。患者心率加快，大量阴道流血，急查血常规（C对），给予静脉输液扩容，给予止血药物（B对），预防休克。为确认患者是否为妊娠导致大出血，应予查血β-hCG（D对）。